男，59岁，突发持续性胸痛3小时，黑朦1次，高血压病史5年，间断服用降压药物。查体：BP85/50mmHg，心率35次/分，心律齐，心电图示Ⅱ，Ⅲ，aVF导联ST段抬高，0.3mV，三度房室传导阻滞。在置入临时起搏器以前，提高该患者心率的药物治疗措施是
A. 肾上腺静脉注射
B. 多巴酚丁胺静脉滴注
C. 阿托品静脉注射
D. 去甲肾上腺素静脉滴注
E. 异丙肾上腺素静脉滴注

正确答案：C。阿托品静脉注射

解析：中年男性患者，突发持续胸痛3小时（心肌梗死典型症状），黑朦1次，高血压病史5年，间断服用降压药物（血压控制差）。查体：BP85/50mmHg，心率35次/分，心律齐，心电图示Ⅱ、Ⅲ，aVF导联ST段抬高0.3mv，三度房室传导阻滞（提示下壁心梗）。综合该患者的病史，查体，辅助检查，该患者的诊断考虑为急性下壁心肌梗死。急性下壁心肌梗死时，由于迷走神经亢进或供应窦房结、房室结的血流减少或中断，导致兴奋传导减慢，从而产生窦性心动过缓等缓慢性心律失常。较大剂量的阿托品通过阻断窦房结M₂受体而解除了迷走神经对心脏的抑制作用，引起心率加快，阿托品也可拮抗迷走神经过度兴奋所致的房室传导阻滞和心律失常（C对）；肾上腺素主要激动α和β受体，主要用于溺水、麻醉和手术过程中的意外等所致的心脏骤停（A错）；多巴酚丁胺主要激动β₁受体，本品的正性肌力作用明显，主要用于治疗心肌梗死并发心力衰竭（B错）；去甲肾上腺素主要激动α受体，应用仅限于早期神经源性休克以及嗜铬细胞瘤切除后或药物中毒时的低血压（D错）；异丙肾上腺素激动β受体，主要用于心搏骤停、房室传导阻滞以及感染性休克；但异丙肾上腺素静脉给药时，可引起舒张压明显下降，降低冠脉血管的灌注压，而且异丙肾上腺素会明显增加心肌耗氧量，所以不适用于急性心肌梗死的患者（E错）。